男，14岁，发热、干咳伴全身肌瘫2天，胸部X线片示间质性肺炎，同班级中数人有类似症状。治疗首选的是
A. 头孢唑啉
B. 左氧氟沙星
C. 庆大霉素
D. 克林霉素
E. 阿奇霉素

正确答案：E。阿奇霉素

解析：患者为男性儿童（支原体肺炎的好发年龄），发热、咳嗽伴肌瘫，X线片示间质性肺炎（支原体肺炎的典型胸片改变），临床表现和辅助检查都符合肺炎支原体肺炎，治疗首选大环内酯类抗生素，如红霉素、阿奇霉素（E对）。大环内酯类药物不敏感者可选用左氧氟沙星（B错）。头孢唑啉（A错）对革兰阳性菌如金葡菌、溶血性链球菌、肺炎球菌等有较强的作用，对革兰阴性菌的作用也较强。克林霉素（D错）适用于革兰阳性菌及厌氧菌的感染。庆大霉素（C错）属于氨基糖苷类抗生素，有强烈的耳毒性，且抗菌谱并不包括肺炎支原体，故不作首选。